细菌的生化反应，产气肠杆菌为
A. ++--
B. --++
C. +-+-
D. -+-+
E. +--+

正确答案：B。--++

解析：细菌的生化反应，常用的生化反应的方法有吲哚（I）、甲基红（M）、VP（Vi）、枸橼酸盐利用（C）4种试验即IMViC试验，糖发酵试验、硫化氢试验及尿素酶分解试验等。大肠埃希菌IMViC试验结果为“++--”，产气肠杆菌为“--++”。掌握“细菌的生理”知识点。